研究某口腔医院过去几年来初诊主述变化的流行病学方法，称为
A. 横断面研究
B. 纵向研究
C. 常规资料分析
D. 病例-对照研究
E. 群组研究

正确答案：C。常规资料分析

解析：常规资料分析又称历史资料分析，即对已有的资料或者疾病监测记录做分析或总结。如病史记录、疾病监测资料等。掌握“口腔流行病学概述及研究方法”知识点。